病例对照研究中，疾病与研究因素可能相关的推论理由是
A. 病例组的发病率显著高于对照组
B. 病例组的相对危险度显著高于对照组
C. 病例组的病死率显著高于对照组
D. 病例组的归因危险度显著高于对照组
E. 病例组的暴露率显著高于对照组

正确答案：E。病例组的暴露率显著高于对照组